哪个牙的牙尖偏远中
A. 上颌乳尖牙
B. 下颌乳尖牙
C. 上颌乳中切牙
D. 上颌第二乳磨牙
E. 下颌第一乳磨牙

正确答案：A。上颌乳尖牙

解析：上颌乳尖牙牙尖长大，约为牙冠长度的一半，近中斜缘长于远中斜缘，牙尖偏远中，此为上颌乳尖牙最主要的解剖特征。掌握“上下颌前牙的外形及临床应用解剖”知识点。